某地冠心病的死亡率为15‰，说明该地
A. 每1000个住院患者中平均有15人死亡
B. 每1000个心血管病患者中有15人死于冠心病
C. 每1000个冠心病患者中有15人死于该病
D. 每1000人中平均有15人死于冠心病
E. 每1000个死亡患者中平均有15人死于冠心病

正确答案：D。每1000人中平均有15人死于冠心病